诊断心脏和大血管病变最常用的检查方法是
A. X线检查
B. 数字化减影血管造影
C. 超声检查
D. CT检查
E. MRI检查

正确答案：A。X线检查

解析：心脏X线（A对）平片可检查有无心脏增大，充血性心力衰竭等，还可以发现超声难以发现的异常，如主动脉瘤，主动脉缩窄，主动脉夹层和心、大血管旁肿块，为最常用的心脏和大血管检查方法。数字化减影血管造影（B错）主要用于应用于脑血管病检查，特别是对于动脉瘤、动静脉畸形等定性定位诊断，禁用于心力衰竭和严重冠状动脉病变；超声检查（C错）可以观察心脏、大血管的结构形态和搏动情况，了解房室大小、室壁厚度，瓣膜关闭、开放的活动规律，较准确地测定患者的心功能；CT检查（D错）可用于判断冠脉管腔狭窄程度和管壁钙化情况，但其对狭窄程度的判断有一定限度，特别当钙化存在时会显著影响判断；MRI检查（E错）对软组织成像效果好，无需对比剂就可直观地显示心脏与大血管内部解剖结构及其周围相应关系，但临床上不如X线常用。